患者，女，9岁，左上大牙咬物时疼痛半年余，伴出血，长期未用患侧咀嚼检查：左上Ⅴ近中邻面龋，龋洞内见息肉样物，探（+），易出血，叩（±），息肉蒂部来源于牙髓。X线示左上Ⅴ深龋已达髓腔，髓室底完整，根尖无破坏。诊断是
A. 牙龈增生
B. 牙龈息肉
C. 牙髓息肉
D. 急性牙髓炎
E. 慢性根尖炎

正确答案：C。牙髓息肉

解析：本题考查牙髓息肉。患者，女，9岁，左上大牙咬物时疼痛半年余，伴出血，长期未用患侧咀嚼检查：左上Ⅴ近中邻面龋，龋洞内见息肉样物，探（+），易出血，叩（±），息肉蒂部来源于牙髓。X线示左上Ⅴ深龋已达髓腔，髓室底完整，根尖无破坏。诊断是牙髓息肉（C对）。根据题目中的信息左上Ⅴ近中邻面龋，龋洞内见息肉样物，息肉蒂部来源于牙髓，髓室底完整，根尖无破坏，可诊断为牙髓息肉。牙龈增生是牙龈的炎症性表现，覆盖在牙颈部牙冠表面，不是在龋洞内见到息肉（A错）。若为牙龈息肉，自蒂部将息肉切除，见出血部位位于患牙邻面龋洞龈阶外侧的龈乳头位置（B错）。急性牙髓炎和慢性根尖炎不能见到息肉状肉芽组织（DE错）。